患慢性肾炎10年病人，近2周来持续性少尿，浮肿恶心，伴呼吸困难，BP180/100mmHg，心率110次/分，两肺底可闻湿啰音，BUN54mmol/L，二氧化碳结合力15mmol/L，静注速尿60mg无效，下列最有效治疗措施
A. 透析疗法
B. 低盐饮食
C. 静注西地兰
D. 静滴血管扩张药
E. 加大速尿剂量

正确答案：A。透析疗法